村镇规划的原则是
A. 全面规划、节约用地、有利于可持续发展
B. 全面规划、合理布局、节约用地、统筹安排、有利于可持续发展
C. 合理布局、节约用地、有利于可持续发展
D. A＋C
E. A＋B＋C

正确答案：B。全面规划、合理布局、节约用地、统筹安排、有利于可持续发展

解析：本题考查乡村规划的原则。乡村规划应当从农村实际出发，尊重村民意愿，体现地方和农村特色，做到全面规划、合理布局、节约用地、统筹安排、有利于可持续发展（B对ABCE错）。